学校安排课程时，总把音乐、体育、美术、劳动等课程穿插在语文、数学、英语等课程中，这正体现了大脑皮层的
A. 始动调节
B. 动力定型
C. 优势法则
D. 保护性抑制
E. 镶嵌式活动

正确答案：E。镶嵌式活动